BMI的计算公式为
A. 体重（kg）/身高（m）
B. 身高（m）/体重（kg）
C. 体重（kg）/[身高（m）]²
D. [体重（kg）]²/身高（m）
E. [身高（m）]²/体重（kg）

正确答案：C。体重（kg）/[身高（m）]²

解析：本题考查BMI的计算公式。BMI的计算公式为：体质指数（BMI）＝体重（kg）/[身高（m）]²（C对ABDE错）。